下述哪一因素不会使心肌的收缩性减弱？
A. 心肌收缩相关的蛋白改变
B. 心肌能量代谢紊乱
C. 轻度低钾血症
D. 心肌兴奋-收缩耦联障碍
E. 心肌肥大的不平衡生长

正确答案：C。轻度低钾血症

解析：心室肌细胞动作电位2期（平台期）的长短取决于Ca2+、Na+内向电流和K+外向电流的变化。轻度低钾血症（C对）时，其对Ca2+内流的抑制作用减弱，因而2期时Ca2+内流增多，心肌收缩性增强。心肌收缩性减弱的原因主要分为心肌收缩相关的蛋白改变（A错）、心肌能量代谢紊乱（B错）和心肌兴奋－收缩耦联障碍（D错）。心肌肥大的不平衡生长（E错）时，肌原纤维排列紊乱，心肌的收缩性减弱。